曾引起流感大流行的流感病毒亚型是
A. H₁N₁
B. H₃N₃
C. H₅N₁
D. H₇N₇
E. H₉N₂

正确答案：A。H₁N₁

解析：根据病毒NP和M1抗原性的不同，流感病毒分为甲（A）、乙（B）和丙（C）三型，甲型流感病毒再根据HA和NA的抗原性不同分为若干亚型，HA可分为H1～H16亚型，NA可分为N1～N9亚型，人类流感主要与H1、H2、H3和N1、N2亚型有关。甲型流感病毒宿主广泛，易发生变异，曾多次引起世界性大流行（A对）。